支配肛门外括约肌的神经为
A. 生殖股神经
B. 臀下神经
C. 肛神经
D. 坐骨神经
E. 无

正确答案：C。肛神经

解析：生殖股神经（A错）分布于提睾肌和阴囊。臀下神经（B错）支配臀大肌。阴部神经发出肛神经（C对）分布于肛门外括约肌和肛门部皮肤，坐骨神经（D错）支配股二头肌、半腱肌和半膜肌，同时也有分支至髋关节。